中医妇科治法中，滋肾益阴的代表方剂是
A. 左归丸
B. 寿胎丸
C. 归肾丸
D. 大补元煎
E. 补肾固冲丸

正确答案：A。左归丸

解析：左归丸是滋肾益阴的代表方（A对）；寿胎丸（菟丝子、桑寄生、川续断、阿胶）补肾安胎，滋肾益阴不如左归丸（B错）；归肾丸（熟地、山药、山茱萸肉、茯苓、当归、枸杞、杜仲、菟丝子）补阴益阳，养血填精，除滋阴外兼补肾阳（C错），大补元煎（人参、 山药、熟地用、杜仲、当归、山茱萸、 枸杞、炙甘草）救本培元，大补气血，非专于滋肾（D错）；补肾固冲丸（菟丝子、川续断、白术、鹿角霜、巴戟天、枸杞子、熟地、砂仁、党参、阿胶、杜仲、当归头、大枣）补肾固冲，补气健脾，养血安胎（E错）。